男，59岁。外伤致右腕部疼痛、肿胀1小时。既往体健，无糖尿病病史.查体：T36.8℃，P70次/分，R18次/分，BP100/60mmHg，心肺腹未见异常，右腕部疼痛、肿胀、活动受限。X线片检查：桡骨下端骨皮质不连续，对位对线良好，并有嵌插。最恰当的治疗措施是
A. 皮牵引
B. 中药活血化瘀
C. 切开复位内固定
D. 骨牵引
E. 手法复位外固定

正确答案：E。手法复位外固定

解析：桡骨远端骨折分为伸直型骨折、屈曲型骨折及桡骨远端关节面骨折，均首选手法复位外固定（E对）；仅在手法复位不成功或外固定不能维持复位时采取切开复位钢板内固定（C错）。中药活血化瘀（B错）对骨折而言主要为辅助保守治疗。皮牵引（A错）和骨牵引（D错）仅适用于无位移骨折。